一男性手术时曾输血800ml，1个月后出现恶心、呕吐、黄疸等症状，怀疑为输血后肝炎，进行实验室确诊首先应检查的是
A. 抗-HAV
B. 抗-HCV
C. 抗-HDV
D. 抗-HEV
E. 抗-CMV

正确答案：B。抗-HCV